关于寻常疣的特点，叙述错误的是寻常疣
A. 病变为外生性
B. 中心为血管结缔组织
C. 增生的复层扁平上皮呈指状突起
D. 上皮表层通常有不全角化或正角化
E. 有溃疡

正确答案：E。有溃疡

解析：寻常疣病变为外生性，增生的复层扁平上皮呈指状突起，其中心为血管结缔组织支持。上皮表层通常有不全角化或正角化，也可能无角化。掌握“乳头状瘤及牙龈瘤”知识点。